番泻叶粉末遇碱液显
A. 棕褐色
B. 红色
C. 污绿色
D. 橙黄色
E. 黄棕色

正确答案：B。红色

解析：本题考查的是醌类化合物的显色反应。番泻叶粉末遇碱液显红色（B对）。番泻叶中致泻的主要成分番泻苷A、B、C、D等皆为二蒽酮类衍生物，可发生Bornträger's反应。Bornträger's反应：在碱性溶液中，羟基醌类颜色改变并加深，多呈橙、红、紫红及蓝色。如羟基蒽醌类化合物遇碱显红至紫红色，称为Borntäger's反应。蒽酚、蒽酮、二蒽酮类化合物需氧化形成羟基蒽醌后才能显色，其机制是形成了共轭体系。棕褐色（A错）为二氢黄酮与磷钼酸试剂的颜色特征。近年来报道二氢黄酮可与磷钼酸试剂反应而呈棕褐色，可作为二氢黄酮类化合物的特征鉴别反应。污绿色（C错）为强心苷与Liebermann-Burchard反应的颜色特征。Liebermann-Burchard反应（醋酐-浓硫酸反应）：将样品溶于三氯甲烷，加醋酐-浓硫酸（20：1），产生红色→紫色→蓝色→绿色→污绿色等颜色变化，最后褪色。也可将样品溶于冰醋酸，加试剂产生同样的反应。橙黄色（D错）为士的宁与浓硫酸/重铬酸钾反应的颜色特征。士的宁加浓硫酸1ml，加少许重铬酸钾晶体，最初显蓝紫色，渐变为紫堇色、紫红色，最后为橙黄色。黄棕色（E错）为乌头碱与Frohde试剂反应的颜色特征。Frohde试剂（1%钼酸钠或钼酸铵的浓硫酸溶液）：吗啡显紫色渐转棕色，小檗碱显棕绿色，利血平显黄色渐转蓝色，乌头碱显黄棕色。